具有浅表部抗真菌和深部抗真菌的药物是
A. 灰黄霉素
B. 伊曲康唑
C. 两性霉素
D. 氟康唑
E. 碘苷

正确答案：B。伊曲康唑

解析：本题考查伊曲康唑。具有浅表部抗真菌和深部抗真菌的药物是伊曲康唑（B对）。咪唑类和三唑类抗真菌药均为广谱抗真菌药，可抑制真菌细胞中的麦角固醇合成，抑制真菌生长。常用的有酮康唑、伊曲康唑。用于对新型隐球菌、白念珠菌等深部真菌感染和浅部真菌感染（如甲癣）的治疗。灰黄霉素（A错）为非多烯类抗真菌抗生素，可以有效的治疗浅部真菌病,对念珠菌属及深部真菌感染无效。两性霉素B（C错）是目前治疗深部真菌感染的首选药，对多种深部真菌有强大的抑制作用。氟康唑（D错）可替代伊曲康唑用于芽生菌病和组织胞浆菌病的治疗，少用于浅部真菌感染。碘苷（E错）为抗微生物感染药，用于眼部感染。